自身免疫病最重要的基本特征是
A. 患者血中可测得高效价的自身抗体和/或针对自身Ag的致敏淋巴细胞
B. 自身抗体或致敏淋巴细胞造成组织损伤或功能障碍
C. 病情转归与自身免疫反应强度有关
D. 反复发作或慢性迁延
E. 有遗传倾向

正确答案：A。患者血中可测得高效价的自身抗体和/或针对自身Ag的致敏淋巴细胞